药物的生物利用度是指
A. 药物经胃肠道进入门脉的分量
B. 药物能吸收进入体循环的分量
C. 药物吸收后达到作用点的分量
D. 药物吸收后进入体内的相对速度
E. 药物吸收进入体循环的相对分量和速度

正确答案：E。药物吸收进入体循环的相对分量和速度